醋炙甘遂的炮制目的有
A. 增强疗效
B. 降低毒性
C. 矫臭矫味
D. 缓和泻下
E. 改变药性

正确答案：B、D。降低毒性；缓和泻下